牙体缺损修复治疗的修复体不包括
A. 人造全冠
B. 3/4冠
C. 桩冠
D. 可摘义齿
E. 嵌体

正确答案：D。可摘义齿

解析：本题考查牙体缺损修复体的种类。可摘义齿（D错，为本题正确答案）为牙列缺损修复治疗的修复体，是利用天然牙、基托下黏膜和骨组织作支持，依靠义齿的固位体和基托来固位，用人工牙恢复缺失牙的形态和功能，患者可自行摘戴的修复体，常用于缺牙较多的情况。牙体缺损修复治疗的修复体包括全冠（A对）、部分冠（B对）、贴面 、桩核冠（C对）和嵌体（E对）。